目前治疗恶性肿瘤的综合治疗中仍占有极为重要的地位的是哪种方法
A. 化疗
B. 健康保健
C. 中医治疗
D. 营养维持
E. 死亡

正确答案：A。化疗

解析：目前治疗恶性肿瘤的三大主要方法包括化学治疗（简称化疗）、外科手术和放射治疗。应用传统细胞毒类抗肿瘤药或抗癌药进行化疗在肿瘤的综合治疗中仍占有极为重要的地位。掌握“抗恶性肿瘤药”知识点。